血培养结果为耐甲氧西林金黄色葡萄球菌，首选的抗菌药物是
A. 青霉素G
B. 头孢唑林
C. 万古霉素
D. 左氧氟沙星
E. 阿奇霉素

正确答案：C。万古霉素

解析：本题考查抗菌药物的作用特点。万古霉素（C对）可用于耐药革兰阳性菌所致严重感染，特别是甲氧西林耐药葡萄球菌属（MRSA及MRCNS）、肠球菌属及青霉素耐药肺炎链球菌所致败血症、心内膜炎、脑膜炎、肺炎、骨髓炎等；②中性粒细胞减少或缺乏症合并革兰阳性菌感染患者；③青霉素过敏或经其他抗生素治疗无效的严重革兰阳性菌感染患者；④口服万古霉素可用于经甲硝唑治疗无效的艰难梭菌所致假膜性肠炎患者。